在tRNA二级结构的Tφ环中φ（假尿苷）的糖苷键是
A. C-H连接
B. C-N连接
C. N-N连接
D. N-H连接
E. C-C连接

正确答案：E。C-C连接